和肉类相比较，鱼类中
A. 脂肪含量较高，且多为饱和脂肪酸
B. 脂肪含量较低，且多为饱和脂肪酸
C. 脂肪含量较高，且多为不饱和脂肪酸
D. 脂肪含量较低，且多为不饱和脂肪酸
E. 不含胆固醇

正确答案：D。脂肪含量较低，且多为不饱和脂肪酸